下列药物中具有肾毒性的是
A. 青霉素
B. 头孢曲松
C. 庆大霉素
D. 左氧氟沙星
E. 红霉素

正确答案：C。庆大霉素

解析：庆大霉素属于氨基糖苷类抗生素，氨基糖苷类是诱发药源性肾衰竭的最常见因素，这类药物虽经肾小球滤过，但对肾组织有极高亲和力，通过细胞膜吞饮方式而大量积聚在肾皮质，导致肾小管、尤其是近曲小管上皮细胞溶酶体破裂，线粒体损害，钙调节转运过程受阻，轻则引起肾小管肿胀，重则产生急性坏死（C对）。青霉素和头炮曲松属于β-内酰胺类抗生素，最常见的不良反应为药物过敏反应（AB错）。左氧氟沙星属于喹诺酮类抗生素，不良反应为胃肠道反应、光敏反应和软骨损害等（D错）。红霉素属于大环内酯类抗生素，不良反应为胃肠道直接刺激、肝脏损害等（E错）。